某温度计厂男工，42岁，工作十余年。近来有乏力、记忆力减退、失眠和多梦等症，常因琐事与人口角、事后又忧郁胆怯，近日发现他的字迹弯弯曲曲。首选的治疗药物为
A. 依地酸二钠钙
B. 二巯基丙磺酸钠
C. 谷胱甘肽
D. 葡萄糖酸钙
E. 美蓝

正确答案：B。二巯基丙磺酸钠

解析：本题考查汞中毒的治疗药物。汞中毒初期表现为类神经症，如头昏、乏力、健忘、失眠、多梦、易激动等，部分病例可有心悸、多汗等自主神经系统紊乱现象，病情进一步发展则会发生性格改变，如急躁、易怒、胆怯、害羞、多疑等。震颤是神经毒性的早期症状，如头部震颤和运动失调。题中工人的自主神经系统紊乱和性格改变等现象是由于长期接触汞引起的慢性汞中毒。针对汞中毒的治疗，应采取驱汞治疗的方案，用二巯基丙磺酸钠（B对ACDE错）或二巯基丁二酸钠治疗。